一般类型急性上呼吸道感染的患儿，部分早期会出现“脐周阵痛”，可能的原因是
A. 肠系膜淋巴结炎
B. 剧烈咳嗽
C. 头痛
D. 剧烈呕吐
E. 下颌下淋巴结炎

正确答案：A。肠系膜淋巴结炎

解析：在一般类型急性上感的患儿中，部分患儿会出现“脐周阵痛”，此现象主要原因是与发热所致的反射性肠蠕动增强或肠系膜淋巴结炎有关。掌握“急性上呼吸道感染”知识点。